下列关于体液的叙述，哪项是正确的
A. 成年女性的体液量约占体重的60%
B. 细胞内液量在男性约占体重的40%，绝大多数存在于骨骼肌中
C. 血浆约占体重的10%
D. 脑脊液关节液消化液等属于功能性细胞外液
E. 细胞外液和细胞内液的渗透压一般为260～280mOsm/L

正确答案：B。细胞内液量在男性约占体重的40%，绝大多数存在于骨骼肌中

解析：细胞内液量在男性约占体重的40%，绝大多数存在于骨骼肌中（B对）。成年女性的体液量约占体重的50％（A错）。血浆约占体重的5%（C错）。脑脊液关节液消化液等属于无功能性细胞外液（D错）。细胞外液和细胞内液的渗透压一般为280～310mOsm/L（E错）。